醋炙后有助于生物碱类成分煎出的中药是
A. 柴胡
B. 鳖甲
C. 延胡索
D. 斑蝥
E. 乳香

正确答案：C。延胡索

解析：本题考查的是延胡索的炮制作用。醋炙后有助于生物碱类成分煎出的中药是延胡索（C对）。延胡索：【炮制作用】延胡索味辛、苦，性温。归肝、脾经。具有活血、利气、止痛的功能。用于胸胁、脘腹疼痛，经闭痛经，产后瘀阻，跌打肿痛等证。①生品止痛有效成分不易煎出，效果欠佳，故临床多用醋制品。②醋延胡索行气止痛作用增强，广泛用于身体各部位的多种疼痛证候。③酒延胡索以活血、祛瘀、止痛为主。延胡索镇痛的有效成分为生物碱，醋制可以使难溶于水的游离生物碱生成盐，提高煎出率，与传统认为醋制增强其止痛作用吻合。醋制、酒制均能提高延胡索生物碱和延胡索乙素的煎出量，从而增强镇痛和镇静作用。延胡索中季铵碱具降压、增加冠脉血流量的作用，炮制后含量降低，因此用于治疗冠心病，宜生用。柴胡（A错）：【炮制作用】柴胡味辛、苦，性微寒。归肝、胆、肺经。具有疏散退热、疏肝解郁、升举阳气的功能。用于感冒发热，寒热往来，胸胁胀痛，月经不调，子宫脱垂，脱肛。①生品升散作用较强，多用于解表退热。②醋柴胡的升散之性缓和，疏肝止痛的作用增强。多用于肝郁气滞的胁肋胀痛，腹痛及月经不调等症。③鳖血柴胡能填阴滋血，抑制其浮阳之性，增强清肝退热的功效。可用于热入血室，骨蒸劳热。鳖甲（B错）：【炮制作用】鳖甲味咸，性微寒。归肝、肾经。具有滋阴潜阳，退热除蒸，软坚散结的功能。①鳖甲质地坚硬，有腥臭气。养阴清热、潜阳息风之力较强，多用于热病伤阴或内伤虚热、虚风内动。②醋鳖甲质变酥脆，易于粉碎及煎出有效成分，并能矫臭矫味。醋制还能增强药物入肝消积、软坚散结的作用。常用于癥瘕积聚，月经停闭。斑蝥（D错）：【炮制作用】斑蝥味辛，性热；有大毒。归肝、胃、肾经。具有破血消癥，攻毒蚀疮的功能。①生斑蝥多外用，毒性较大，以攻毒蚀疮为主。用于瘰疬瘘疮，痈疽肿痛，顽癣瘙痒。②米炒斑蝥毒性降低，其气味得到矫正，可内服。以通经、破癥散结为主。用于经闭癥瘕，狂犬咬伤，瘰疬，肝癌，胃癌。乳香（E错）：【炮制作用】乳香味辛、苦，性温。归心、肝、脾经。具有活血止痛、消肿生肌的功能。用于胸痹心痛，胃脘疼痛，痛经经闭，产后瘀阻，癥瘕腹痛，风湿痹痛，筋脉拘挛，跌打损伤，痈肿疮疡。①生品气味辛烈，对胃的刺激较强，易引起呕吐，但活血消肿，止痛力强，多用于瘀血肿痛或外用。②醋乳香刺激性缓和，利于服用，便于粉碎。醋炙乳香还能增强活血止痛、收敛生肌的功效，并可以矫臭矫味。③炒乳香作用与醋乳香基本相同。